若上颌侧切牙切缘出现牙釉质发育不全表示致病因素已延续到
A. 出生前
B. 1岁以内
C. 出生后第2年
D. 2～3岁以后
E. 4岁以后

正确答案：C。出生后第2年

解析：本题考查牙釉质发育不全的临床表现。由于致病因素出现在牙发育期才会导致釉质发育不全，故受累牙往往呈对称性。所以，可根据釉质发育不全的部位，推断致病因素作用的时间。12、22的釉质和牙本质在出生后1年左右才开始沉积，当12、22的切缘被累及时，可推断致病因素已延续到出生后第2年（C对A错）。11、13、16、21、23、26、31、32、33、36、41、42、43、46的切缘或牙尖出现釉质发育不全，表示致病因素发生在1岁以内（B错）。如前牙未受累，主要表现在14、15、17、24、25、27、34、35、37、44、45、47，则致病因素的发生在2～3岁以后（DE错）。